患者，女，62岁，患有2型糖尿病，平时未规律检测血糖，今日来院复诊，欲了解3个月内的血糖总体控制情况，应检测的指标是
A. 血红蛋白
B. 糖化血红蛋白
C. 空腹血糖
D. 餐后2小时血糖
E. 总胆固醇

正确答案：B。糖化血红蛋白

解析：本题考查血生化检查。患者，女，62岁，患有2型糖尿病，平时未规律检测血糖，今日来院复诊，欲了解3个月内的血糖总体控制情况，应检测的指标是糖化血红蛋白（B对）。糖化血红蛋白反映过去 个月的平均血糖水平，其增高主要见于糖尿病及其他高血糖状态。血红蛋白（A错）在临床上可用于诊断某些变性血红蛋白症和血液系统疾病。空腹血糖（C错）、餐后2小时血糖（D错）用于监测糖尿病的病情和治疗效果。总胆固醇（E错）是临床上血脂分析的重要指标。